为了解某市慢性病的分布情况，在该市随机抽取3个城区，每个城区随机抽取2个社区，对抽取的社区内所有50岁及以上的中老年人进行调查。该调查采取的抽样方法为
A. 分层抽样
B. 整群抽样
C. 单纯随机抽样
D. 方便抽样
E. 系统抽样

正确答案：B。整群抽样